男，50岁，有心脏病史多年。査体：BP150/40mmHg，可及水冲脉，毛细血管搏动征阳性，股动脉可闻及枪击音。与上述临床表现相对应的体征是
A. 胸骨右缘第2肋间舒张期杂音
B. 胸骨左缘第3肋间舒张期杂音
C. 心尖部舒张期杂音
D. 胸骨左缘第3肋间收缩期杂音
E. 心尖部收缩期杂音

正确答案：B。胸骨左缘第3肋间舒张期杂音

解析：患者中年男性，有心脏病史，收缩压升高（正常值90～139mmHg），舒张压降低（正常值60～89mmHg），脉压差明显增大（正常值30～40mmHg），可及水冲脉，毛细血管搏动征阳性，股动脉可闻及枪击音，首先考虑诊断为主动脉瓣关闭不全。主动脉瓣关闭不全的特征性杂音为高调叹气样舒张期杂音，在主动脉瓣区（胸骨右缘第2肋间）和主动脉瓣第二听诊区（胸骨左缘第3肋间）都可听到，但一般舒张期杂音在主动脉瓣第二听诊区更加明显，收缩期杂音在主动脉瓣区更加明显，因此本题的最佳答案应为胸骨左缘第3肋间舒张期杂音（B对），而不是胸骨右缘第2肋间舒张期杂音（A错）。心尖部舒张期杂音（C错）多发生于二尖瓣狭窄患者。胸骨左缘第3肋间收缩期杂音（D错）多发生于室间隔缺损患者。心尖部收缩期杂音（E错）多发生于二尖瓣关闭不全患者。